对某小学学生进行视力检查，五年级总人数80人，视力低下的人数为30人，调查所有学生视力低下的人数为100人。则五年级视力低下占全体视力低下的构成比
A. 0.1
B. 0.2
C. 0.25
D. 0.3
E. 0.8

正确答案：D。0.3

解析：构成比的计算公式为，构成比=该事物内部某一组成部分的观察单位数（例数）/某事物内部的所有观察单位之和（例数之和）×100%。五年级视力低下占全体视力低下的构成比=五年级视力低下的人数/调查所有学生视力低下的人数=30/100=0.3（D对）。